婴幼儿易患呼吸道感染的原因之一是其局部缺乏
A. IgA
B. IgG
C. IgM
D. IgD
E. IgE

正确答案：A。IgA

解析：本题考查婴幼儿易患呼吸道感染的原因。婴幼儿易患呼吸道感染的原因之一是其局部缺乏IgA（A对）。IgG（B错）是再次免疫应答的产生的主要抗体，是抗感染的“主力军”，可穿过胎盘屏障，在新生儿抗感染免疫中起重要作用。IgM（C错）是个体发育过程中最早合成和分泌的抗体，也是初次应答中最早出现的抗体，是机体抗感染的 “先头部队”。IgD（D错）中的膜结合型IgD是B细胞分化发育成熟的标志。IgE（E错）是正常人血清含量最少的Ig，参与I型超敏反应，可能与机体抗寄生虫免疫有关。